男，50岁。晨起刷牙时左口角流水，伴左耳后痛。查体：左额纹消失，左眼闭合无力，左鼻唇沟浅，口角右歪。最可能的诊断是
A. 左面神经炎
B. 吉兰－巴雷综合征
C. 左三叉神经第1支受损
D. 中枢性面瘫
E. 左三叉神经第3支受损

正确答案：A。左面神经炎

解析：中老年男性患者，急性起病，刷牙时口角流水，伴左耳后痛，查体可见左额纹消失，左眼闭合无力，左鼻唇沟浅，口角右歪，可初步判断为左侧周围神经面瘫。左耳后疼痛可考虑为病毒感染累及膝神经节，则该患者可诊断为左面神经炎（A对）。吉兰-巴雷综合征（B错）多为双侧周围性面瘫，伴有对称性四肢迟缓性瘫和感觉障碍。中枢性面瘫（D错）上部面肌不受累，不会出现额纹消失及眼闭合无力症状。左三叉神经第1支（眼神经）（C错）是纯感觉神经，其受损仅表现为受累区域的感觉障碍（P38），左三叉神经第3支（下颌神经）（E错）是混合神经，其受损仅会出现受累区域的感觉障碍及咀嚼肌运动障碍，不会累及整个左侧面部（P38）。